圆孔位于下列何骨上
A. 颞骨
B. 额骨
C. 筛骨
D. 蝶骨
E. 无

正确答案：D。蝶骨

解析：圆孔、卵圆孔、棘孔均是位于蝶骨上（D对）。